治疗急性血栓栓塞性疾病最好选
A. 肝素
B. 华法林
C. 尿激酶
D. 右旋糖酐
E. 双香豆素

正确答案：C。尿激酶